能使肩胛下角外旋助臂上举
A. 斜方肌
B. 背阔肌
C. 菱形肌
D. 前锯肌
E. 肩胛提肌

正确答案：D。前锯肌

解析：斜方肌（A错）拉肩胛骨向脊柱靠拢。背阔肌（B错）使肩关节后伸、内收及旋内。菱形肌（C错）牵引肩胛骨向内上并向脊柱靠拢。前锯肌（D对）拉肩胛骨向前并紧贴胸廓，下部肌束使肩胛骨下角旋外，助外展的臂举高。肩胛提肌（E错）上提肩胛骨。